女，35岁。脸变圆、向心性肥胖2年，皮肤紫纹半年。最可能的诊断是
A. 特发性醛固酮增多症
B. 肾上腺皮质功能减退症
C. 单纯性肥胖
D. 糖尿病
E. 库欣综合征

正确答案：E。库欣综合征

解析：中年女性患者，脸变圆、向心性肥胖、皮肤紫纹（皮质醇增多症典型表现），最可能的诊断是库欣综合征（E对）。特发性醛固酮增多症（A错）最常出现的症状为高血压。肾上腺皮质功能减退症（B错）最具特征性者为全身皮肤色素加深，暴露处、摩擦处、乳晕、瘢痕等处尤为明显，黏膜色素沉着见于牙龈、舌部、颊黏膜等处，系垂体ACTH、黑素细胞刺激素分泌增多所致。单纯性肥胖（C错）亦无题述特异表现。糖尿病（D错）常表现为三多一少：即多尿、多饮、多食和体重减轻（P729）。